对感染性腹泻进行监测应选择的疾病频率测量指标是
A. 期间患病率
B. 现患率
C. 罹患率
D. 发病率
E. 病死率

正确答案：C。罹患率

解析：发病率指在一定期间内（一般为1年）、特定人群中某病新发病例出现的频率”。（P29）“罹患率与发病率一样，也是测量人群新病例发生频率的指标，计算方法同发病率：与发病率相比，罹患率适用于小范围、短时间内疾病频率的测量，观察期限可以以日、周、旬、月为单位（C对D错）”。感染性腹泻更适合罹患率。现患率（B错）（P29）所谓的现患率也称患病率，其实质是一个比值而不是率。一般用来表示被研究人口中患某疾病或处于某种状态的人口比例。常用于描述危险因素和疾病及其他情况，一般不用于疾病的监测。期间患病率（A错）属于患病率的一种，也不用于疾病发病情况的监测。病死率（E错）表示一定时间内，患某病的全部病人中因该病死亡者所占的比例，它可以反映疾病的严重程度和医疗水平、诊断水平，与疾病发病情况监测无关。